常有翼下颌间隙等感染扩散而来，也可因上颌结节、卵圆孔、圆孔阻滞麻醉时带入感染引起的间隙感染是
A. 颞间隙
B. 眶下间隙
C. 下颌下间隙
D. 颊间隙
E. 颞下间隙

正确答案：E。颞下间隙

解析：颞下间隙感染来源可从相邻间隙，如翼下颌间隙等感染扩散而来；也可因上颌结节、卵圆孔、圆孔阻滞麻醉时带入感染；或由上颌磨牙的根尖周感染或拔牙后感染引起。掌握“翼下颌间隙、颞下间隙感染”知识点。